女，孕25周。合并上呼吸道感染，需使用抗生素。下列抗菌药物中，孕期不能使用的是
A. 青霉素类
B. 氨基糖苷类
C. 头孢菌素类
D. 磷霉素钠
E. 大环内酯类

正确答案：B。氨基糖苷类

解析：女，孕25周，合并上呼吸道感染，需使用抗生素，由于氨基糖苷类有耳毒性，且会影响子宫内胎儿，故孕期不能使用的是氨基糖苷类（B对）。青霉素类（A错）一般不能用于青霉素过敏患者。头孢菌素类（C错）常见的是过敏反应，但是发生过敏性休克少见。磷霉素钠（D错）一般用于治疗肠道、泌尿系统、皮肤和软组织感染，患者为合并上呼吸道感染，故不选用。大环内酯类（E错）一般用于治疗肺部感染等疾病，孕妇可以使用。